“壮水之主，以制阳光”的治法，最适于治疗的是
A. 阴盛则寒之证
B. 阴虚则热之证
C. 阴盛伤阳之证
D. 阴损及阳之证
E. 阳损及阴之证

正确答案：B。阴虚则热之证

解析：阴胜则寒之证即实寒证，应治寒以热，即用“寒者热之”的治法，以温散其阴寒（A错）。阴虚则热之证即虚热证，应用滋阴的方法治疗，即“阳病治阴”或“壮水之主，以制阳光”（B对）。阴盛伤阳之证是指阴寒偏盛的疾病过程中，导致的阳气损伤，治疗应在调整阴偏盛的基础上，配合扶阳之法（C错）。阴损及阳证是阴虚引起的阳虚，以阴虚为主，治疗应在补阳的基础上辅以滋阴之品（D错）。阳损及阴证是阳虚引起的阴虚，以阳虚为主，治疗应在滋阴的基础上辅以补阳之品（E错）。